心肌梗死最常发生的部位在
A. 右心室后壁
B. 左心室后壁
C. 右心室前壁
D. 左心室前壁
E. 左心室侧壁

正确答案：D。左心室前壁

解析：动脉粥样硬化是急性心肌梗死的基本病因，最常累及冠状动脉左前降支，然后依次为右主干、左主干或左旋支、后降支（九版病理学P157）。左前降支闭塞可引起左心室前壁、心尖部等部位发生梗死。因此心肌梗死最常发生的部位在左心室前壁（D对ABCE错）。